哪项不是缺乏维生素B₆的临床症状
A. 脂溢性皮炎
B. 小细胞性贫血
C. 口角炎
D. 癫痫样惊厥
E. 忧郁和精神错乱

正确答案：C。口角炎